静脉注射地西泮速度过快时引起的不良反应是
A. 惊厥
B. 心跳加速
C. 血钙下降
D. 血糖升高
E. 呼吸暂停

正确答案：E。呼吸暂停

解析：本题考查镇静催眠药地西泮。静脉注射地西泮速度过快时引起的不良反应是呼吸暂停（E对），还有心脏骤停，低血压和心动过缓（B错），静脉注射速度应慢一些。